甲状腺结节突然增大伴疼痛是
A. graves病
B. 亚急性甲状腺炎
C. 甲状腺癌
D. 甲状腺乳头状囊性腺样瘤瘤内出血
E. 甲状腺高功能腺瘤

正确答案：B。亚急性甲状腺炎

解析：本题考查甲状腺炎的临床表现。甲状腺结节突然增大伴疼痛是亚急性甲状腺炎（B对）。亚急性甲状腺炎：常继发于病毒性上呼吸道感染，是颈前肿块和甲状腺疼痛的常见原因。多数表现为甲状腺突然肿胀、发硬、吞咽困难及疼痛，并向病侧耳颞处放射。常始于甲状腺的一侧，很快向腺体其他部位扩展。病人可有发热，血沉增快。病程约为3个月，愈后甲状腺功能多不减退。